标定盐酸滴定液（0.1mol/1）的基准物是
A. 硫酸
B. 氯化钠
C. 邻苯二甲酸氢钾
D. 重铬酸钾
E. 无水碳酸钠

正确答案：E。无水碳酸钠

解析：本题考查基准物的选择。标定HCl溶液常用的基准物质是无水碳酸钠（E对），反应为：Na₂CO₃+2HCl=2NaCl+H₂O+CO₂↑以甲基橙作指示剂。